为研究老年人的糖尿病患病率，拟进行抽样调查，下列不属于抽样调查中决定样本含量的因素的是
A. 预期现患率
B. 调查者的数量
C. 个体间的变异程度
D. 精确度
E. 把握度

正确答案：B。调查者的数量

解析：样本含量n=C²σ²/p²，其中p精确度（D对），σ为总体标准差与个体间的变异程度（C对）有关。影响抽样调查中样本含量的因素包括：干预措施的效应大小、Ⅰ型错误的概率、把握度（E对）、单侧或双侧检验、研究对象分组数量等，而与调查者的数量无关（B错，为本题正确选项）。